在水溶液中不稳定，临用时需现配的药物是
A. 盐酸普鲁卡因
B. 盐酸氯胺酮
C. 盐酸氯丙嗪
D. 青霉素钠
E. 硫酸阿托品

正确答案：D。青霉素钠

解析：本题考查药物在水溶液中的稳定性。在水溶液中不稳定，临用时需现配的药物是青霉素钠（D对）。青霉素和头孢菌素类属于酰胺类药物，水解后生成酸与胺，其药物的分子中存在着不稳定的β-内酰胺环，在H⁺或OH⁻影响下，易裂环失效。盐酸普鲁卡因（A错）属于含有酯键的药物，在水溶液中或吸收水分后，易发生水解反应。盐酸氯胺酮（B错）在水中易溶。盐酸氯丙嗪（C错）易氧化。硫酸阿托品（E错）是抗胆碱药，易水解。